女，28岁，初孕，平素月经规律，妊娠40周，孕期检查正常，今自觉胎动减少，查体：T36.0℃，P70次/分，R20次/分，BP110/70mmHg，超声检查：羊水最大暗区2.5cm，指数7.0cm，检查：宫颈管未消，宫口未开，先露-3，胎心率120次/分。对该孕妇首选的处理措施是
A. 米索前列醇引产
B. 催产素激惹实验（OCT）
C. 静脉注射地西泮
D. 人工破膜
E. 静脉滴注缩宫素引产

正确答案：B。催产素激惹实验（OCT）

解析：成年女性患者，初孕，平素月经规律，妊娠40周，孕期检查正常，今自觉胎动减少，查体：T36.0℃（正常值36.0～37.0℃），P70次/分（正常值60～100次/分），R20次/分（正常值16～20次/分），BP110/70mmHg（正常值90～120/60～80mmHg），超声检查：羊水最大暗区2.5cm（正常值3～8cm），指数7.0cm（正常值5～18cm），检查：宫颈管未消，宫口未开，先露-3（胎头颅骨最低点在坐骨棘平面上3cm），胎心率120次/分（正常值110～160次/分）。患者目前足月产，羊水偏少可能存在胎盘功能减退，应首先预测胎儿的储备能力，即首选检查是催产素激惹实验（OCT），通过诱发宫缩，用胎儿监护仪记录胎心率变化，了解胎盘于宫缩时一过性缺氧的负荷变化，测定胎儿的储备能力（B对）。引产是指妊娠12周后，因母体或胎儿方面的原因，须用人工方法诱发子宫收缩而结束妊娠，该孕妇无腹痛，无宫缩，未临产，且胎心正常，目前尚无引产指征，所以不用米索前列醇引产（A错）、静脉滴注缩宫素引产（E错）。静脉注射地西泮（C错）适用于初产妇临产后精神紧张、疲劳。人工破膜（D错）是第一产程的处理措施。